应用胆碱酯酶复活剂应注意
A. 切勿两种或三种复活剂同时使用，以免毒性增加
B. 复活剂对毒蕈碱样作用较强
C. 复活剂不需稀释，直接注射
D. 中毒已超过3日使用复活剂仍然有效
E. 与阿托品联合应用无协同作用

正确答案：A。切勿两种或三种复活剂同时使用，以免毒性增加

解析：本题考查胆碱酯酶复活剂的使用。应用胆碱酯酶复活剂的注意事项：切勿两种或三种复活剂同时使用，以免毒性增加（A对）。复活剂对解除烟碱样作用和促使患者昏迷苏醒的作用比较明显；对毒蕈碱样作用和防止呼吸中枢抑制的作用较差（B错），故与阿托品合用可取得协同效果（E错）。复活剂用量过大、注射过快或未经稀释直接注射（C错），均可引起中毒，须特别注意。对复活剂有效的有机磷农药或杀虫剂中毒，除要尽早应用（D错）外，须根据中毒程度，给予合理的剂量和应用时间。